哺乳期妇女使用，易诱发新生儿胆红素脑病的药物是
A. 复方炔诺酮
B. 依那普利
C. 胰岛素
D. 磺胺嘧啶
E. 莫西沙星

正确答案：D。磺胺嘧啶

解析：本题考查常用药物对乳儿的影响。哺乳期妇女使用，易诱发新生儿胆红素脑病的药物是复方磺胺甲噁唑（D对）。复方磺胺甲噁唑为磺胺类药物，磺胺类药物在乳汁中的浓度与血浆中一致，在体内与胆红素竞争血浆蛋白，可致游离胆红素增高，尤其在新生儿黄疽时，可促使发生新生儿胆红素脑病（核黄疸）。复方炔诺酮（A错）为口服避孕药，因含雌激素和（或）孕激素，可分泌至乳汁中，降低乳汁中吡哆醇含量，使乳儿出现易激惹、尖叫、惊厥等神经精神系统症状；男婴则出现乳房增大。哺乳期妇女避孕禁止应用口服避孕药。依那普利（B错）对乳儿肾脏有影响，避免应用。胰岛素（C错）对乳儿安全无害。莫西沙星（E错）属于喹诺酮类药物，对乳儿关节有潜在危害，不宜使用。